《中国药典》规定崩解时限为5分钟的制剂是
A. 含片
B. 普通片
C. 泡腾片
D. 肠溶片
E. 薄膜衣片

正确答案：C。泡腾片

解析：本题考查《中国药典》规定下固体制剂的崩解时限。泡腾片（C对）、舌下片崩解时限为5分钟；薄膜衣片（E错）崩解时限为30min；分散片、可溶片的崩解时限为3min；普通片剂（B错）崩解时限为15min；肠溶衣片（D错）要求在盐酸溶液中2小时内不得有裂缝、崩解或软化现象，在pH6.8磷酸盐缓冲液中1小时全部溶解并通过筛网等。